下列哪种情况不属于流行病学研究中的偏倚
A. 在调查过去的暴路史时由于记忆不清导致研究结果出现错误
B. 在测量结局时由于标准不统一导致研究结果出现错误
C. 在选择研究对象时由于抽样引起的误差
D. 由于人选的研究对象与未人选者在某些特征上存在差异导致结果出现错误
E. 随访对象流失

正确答案：C。在选择研究对象时由于抽样引起的误差